类风湿关节炎一经确诊，应尽早使用改善病情的抗风湿药（DMARDs）治疗。首选的药物是
A. 柳氮磺吡啶
B. 来氟米特
C. 甲氨蝶呤
D. 环磷酰胺
E. 环孢素

正确答案：C。甲氨蝶呤

解析：本题考查抗风湿药。首选的药物是甲氨蝶呤（C对）。类风湿关节炎一经确诊，应尽早使用改善病情的抗风湿药（DMARDs）治疗。该类药物较NSAIDs发挥作用慢，明显改善症状需要1～6个月，故又称慢作用药。虽不具备即刻止痛和抗炎作用，但有改善和延缓病情进展的疗效。推荐首选甲氨蝶呤（MTX），并将它作为联合治疗的基本药物。也可选用柳氮磺吡啶（A错）或羟氯喹；存在MTX禁忌时，考虑单用来氟米特（B错）或柳氮磺吡啶。环孢素（E错）用于重症类风湿关节炎。环磷酰胺（D错）在多种药物治疗难以缓解病情的特殊情况下，可酌情试用。